麻疹的传播途径是
A. 性传播
B. 接触传播
C. 母婴传播
D. 飞沫传播
E. 血液传播

正确答案：D。飞沫传播

解析：麻疹是小儿时期常见的一种急性呼吸道传染病，临床以发热、上呼吸道炎症、结膜炎、麻疹粘膜斑及全身斑丘疹为特征。麻疹患儿及亚临床带病毒者是传染源，患者口、鼻、咽、气管及眼部的分泌物均含有麻疹病毒，通过喷嚏、咳嗽和说话等飞沫传播（D对）。性传播（A错）、接触传播（B错）、母婴传播（C错）和血液传播（E错）均不是麻疹的传播途径。